某甲肝患者居家隔离，对其家中的床单、被罩等日常生活用品进行消毒，该措施属于
A. 终末消毒
B. 经常性消毒
C. 随时消毒
D. 预防性消毒
E. 化学消毒

正确答案：C。随时消毒

解析：本题考查随时消毒。随时消毒是指当传染源还在疫源地时，对其排泄物、分泌物、被污染的物品及场所进行的及时消毒。本题中甲肝患者居家隔离，对其家中的床单、被罩等日常生活用品进行消毒属于随时消毒（C对）。